以下哪项不属于医学道德教育的特点
A. 专业性与综合性
B. 同时性与层次性
C. 长期性与渐进性
D. 理论性与实践性
E. 参与性与专断性

正确答案：E。参与性与专断性

解析：医学道德教育的特点：专业性与综合性，同时性与层次性，长期性与渐进性，理论性与实践性。掌握“医学道德教育”知识点。